主要用于慢性精神分裂症的药物有
A. 五氟利多
B. 三氟多
C. 氯丙嗪
D. 氟利多
E. 利培酮

正确答案：A、B、E。五氟利多；三氟多；利培酮